含有强心苷的中药是
A. 知母
B. 香加皮
C. 白术
D. 淫羊藿
E. 合欢皮

正确答案：B。香加皮

解析：本题考查的是含强心苷类化合物的常用中药。含有强心苷的中药是香加皮（B对）。香加皮中含有强心苷类化合物为甲型强心苷，其中杠柳毒苷和杠柳次苷为主要成分。知母（A错）中的化学成分主要为甾体皂苷和芒果苷，还含有木脂素、甾醇、鞣质、胆碱等成分。《中国药典》上将知母皂苷BⅡ和芒果苷定为知母药材的质量控制成分，要求知母皂苷BⅡ含量不得少于3.0%，芒果苷的含量不得少于0.7%。饮片指标低于原药材，如蓝知母要求知母皂苷BⅡ含量不得少于2.0%，芒果苷含量不得少于0.40%。淫羊藿（D错）中的淫羊藿苷具有雄性激素样作用。合欢皮（E错）的极性部分的主要成分是三萜皂苷。《中国药典》以（-）-丁香树脂酚-4-O-β-D-呋喃芹糖基-（1→2）-β-D-吡喃葡萄糖苷为指标成分进行含量测定。白术（C错）所含化学成分，2022年考试指南未明确说明。